有关垂直距离恢复正常的是
A. 使面部比例协调
B. 使肌张力正常
C. 发挥最大咀嚼效能
D. 有益于颞下颌关节健康
E. 以上都是

正确答案：E。以上都是

解析：验证垂直距离：将上下颌托戴入口中，检查面部比例是否协调，上下唇闭合是否紧密，口角是否下垂，面部皮肤和肌肉的紧张程度，息止颌间隙的大小，发齿音的清晰程度，触诊咬合时颞肌收缩程度，患者是否感觉舒适，咬合是否有力等。掌握“全口义齿颌位关系及上（牙合）架”知识点。